以下哪一项是转氨酶的辅酶
A. 泛酸
B. 吡哆醛
C. 尼克酸
D. 核黄素
E. 硫胺素

正确答案：B。吡哆醛

解析：转氨酶的辅酶是磷酸吡哆醛和磷酸吡哆胺（含有维生素B6），起着传递氨基的作用。掌握“氨基酸及氨的代谢”知识点。